牙槽骨垂直型吸收的特点，除外
A. 牙槽骨不发生水平方向的吸收
B. 牙槽骨发生垂直或斜行方向的吸收
C. 与牙根面形成角型的骨缺损
D. 牙槽嵴高度降低不多，而牙根周围的骨吸收较多
E. 垂直吸收多形成骨下袋

正确答案：A。牙槽骨不发生水平方向的吸收

解析：本题考查牙槽骨垂直型吸收的特点。牙槽骨垂直型吸收的特点，除外牙槽骨不发生水平方向的吸收（A错，为本题的正确答案）。牙槽骨垂直型也称角形吸收，主要是牙槽骨垂直方向或斜行的吸收（B对），与牙根面之间形成一定角度的骨缺损（C对），牙槽嵴高度降低不多，而牙根周围的骨吸收较多（D对），垂直骨吸收大多形成骨下袋（E对）；也可伴水平方向的吸收，此时牙槽嵴高度降低多。水平型吸收主要是牙槽骨水平方向的吸收，使牙槽骨高度降低，形成骨上袋。